腰穿的禁忌证
A. 脑动脉硬化
B. 神经系统变性病
C. 急性脊髓炎
D. 后颅窝占位病变
E. 神经系统炎症

正确答案：D。后颅窝占位病变

解析：腰椎穿刺的禁忌症有四个：（1）颅内压明显升高，或已有脑疝迹象，腰穿时，脑疝会因为脑脊液压力突然减小而扩大、加重，可压迫延髓导致死亡，后颅窝占位病变（D对）应高度怀疑脑疝，禁止腰穿。（2）腰穿部位有感染灶、脊柱结核或开放性损伤，腰穿可导致感染和结核的扩散。（3）明显出血倾向或病情危急不宜搬动。（4）脊髓压迫症的脊髓功能处于即将丧失的临界状态，腰穿会加快脊髓的衰竭。脑动脉硬化（A错）、神经系统变性病（B错）、急性脊髓炎（C错）、神经系统炎症（E错）均可以通过腰椎穿刺做鉴别诊断、诊断病因、判断疾病性质，是腰椎穿刺的适应症。